患者，女，32岁。小腹及少腹疼痛拒按，有灼热感，伴腰骶疼痛，低热起伏，带下量多，色黄、质稠，溲黄，舌红苔黄腻，脉弦滑。其治法是
A. 清热除湿，化瘀止痛
B. 行气活血，化瘀止痛
C. 疏肝理气，化瘀止痛
D. 凉血活血，化瘀止痛
E. 健脾利湿，化瘀止痛

正确答案：A。清热除湿，化瘀止痛

解析：患者少妇小腹或少腹疼痛拒按，有灼热感，是因为湿热侵袭冲任胞宫，与气血相搏，血行不畅，湿热瘀结；邪正交争，互有进退，低热起伏；湿热下注损伤任带则带下量多，色黄，质稠；热伤津液则溲黄，舌红苔黄腻，脉弦滑是为湿热之象，故治疗要清热利湿，化瘀止痛（A对）。行气活血，化瘀止痛多用于治疗气滞血瘀的少腹痛或痛经（B错）。疏肝理气，化瘀止痛多用于肝郁气滞所导致的腹痛（C错）。凉血活血，化瘀止痛多用于血热溢出脉外而导致的瘀血小腹或少腹疼痛（D错）。健脾利湿，化瘀止痛多用于脾虚湿困，寒湿阻滞脉道所导致的腹痛（E错）。